主要用于控制症状的抗疟药有
A. 氯喹
B. 伯氨喹
C. 奎宁
D. 乙胺嘧啶
E. 青蒿素

正确答案：A、C、E。氯喹；奎宁；青蒿素

解析：本题考查常用抗疟药及其分类。主要用于控制症状的抗疟药有氯喹（A对）、奎宁（C对）、青蒿素（E对）。伯氨喹（B错）为主要用于控制复发和传播的抗疟药。乙胺嘧啶（D错）为主要用于预防的抗疟药。